有关铁的描述，正确的是
A. 食物中的铁以二价铁为主
B. 肠黏膜吸收的铁为二价铁
C. 转铁蛋白结合的铁为二价铁
D. 体内铁蛋白中结合的铁为二价铁
E. 血红蛋白中的铁为三价铁

正确答案：B。肠黏膜吸收的铁为二价铁

解析：人体内的铁吸收过程如下：铁以Fe²⁺的形式被肠黏膜细胞吸收入血（B对）。动物食品中的铁以Fe²⁺为主，可直接吸收，植物食品中的铁以Fe³⁺为主，需还原成Fe²⁺或与铁螯合物结合后吸收。在我国，食物以谷物为主，食物中的铁以Fe³⁺为主（A错）。吸收入血的二价铁经铜蓝蛋白氧化成三价铁，与转铁蛋白结合成血清铁（C错），后者将铁转运到组织或通过幼红细胞膜转铁蛋白受体胞饮入细胞内，再与转铁蛋白分离并还原成二价铁，参与形成血红蛋白（E错）；多余的铁转化成铁蛋白和含铁血黄素，铁蛋白和含铁血黄素都是体内的贮存铁，以Fe³⁺的形式大量贮存于肝、脾、骨髓等的单核-巨噬细胞系统中。